下列关于突发公共卫生事件的分级正确的是
A. Ⅰ级指的是一般事件
B. Ⅱ级指的是重大事件
C. Ⅲ级指的是重大事件
D. Ⅲ级指的是特别重大事件
E. Ⅳ级指的是特别重大事件

正确答案：B。Ⅱ级指的是重大事件